玄参产地加工是
A. 除去杂质晒干
B. 发汗后晒干
C. 煮后晒干
D. 置沸水中烫或煮至透心，刮去外皮晒干
E. 切片后晒干

正确答案：B。发汗后晒干

解析：本题考查的是玄参的采收加工。玄参产地加工是发汗后晒干（B对）。玄参：【采收加工】冬季茎叶枯萎时采挖根。除去根茎、幼芽（供留种栽培用）、须根及泥沙，晒或烘至半干，堆放3～6天“发汗”，反复数次至干燥。除去杂质晒干（A错）的药材为大青叶。大青叶：【采收加工】夏、秋两季分2～3次采收，除去杂质，晒干。第1次在6月中旬，采后及时施肥，第2次在7月下旬，9～10月份可采收第3次。北方地区一般在夏、秋（霜降前后）分2次采收。煮后晒干（C错）的药材为延胡索。延胡索：【采收加工】夏初茎叶枯萎时采挖，除去须根，洗净，置沸水中煮至恰无白心时，取出，晒干。刮去外皮晒干（D错）的药材有白芍。白芍：【采收加工】夏、秋二季采挖，洗净，除去头尾及细根，置沸水中煮后除去外皮或去皮后再煮，晒干。切片后晒干（E错）的药材为鸡血藤。鸡血藤：【采收加工】秋、冬二季采收，除去枝叶，切片，晒干。